在《中国药典》中，右旋糖酐-40氯化钠注射液的检查项目有
A. 吸光度
B. 5-羟甲基糖醛
C. 半乳糖
D. 顺式异构体
E. 分子量与分子量分布

正确答案：E。分子量与分子量分布

解析：本题考查右旋糖酐-40氯化钠注射液的检查项目。右旋糖酐-40氯化钠注射液的检查项目包括pH值、重金属、异常毒性、细菌内毒素及分子量与分子量分布（E对）。